根据阻生第三磨牙的长轴与第二磨牙的长轴关系分类的是
A. 正中位
B. 第Ⅱ类阻生
C. 垂直阻生
D. 低位阻生
E. 高位阻生

正确答案：C。垂直阻生

解析：本题考查阻生牙的分类。根据阻生第三磨牙的长轴与第二磨牙的长轴关系分类的是垂直阻生（C对）。根据阻生牙的长轴与第二磨牙长轴的关系分为垂直、近中、水平、倒置、远中、舌向、颊向阻生七类。正中位（A错）是根据牙在正常牙列中线的位置进行分类的。第Ⅱ类阻生（B错）是根据阻生牙和下颌支前缘的关系分类的。低位阻生（D错）和高位阻生（E错）是根据阻生牙与（牙合）平面的关系分类的。